对下列卫生行政执法特征的描述中不正确的是
A. 执法的主体只能是卫生行政机关
B. 执法主体代表国家
C. 执法针对的对象特定
D. 执法依据必须法定
E. 卫生法的执法范围非常广泛

正确答案：A。执法的主体只能是卫生行政机关

解析：卫生法的执法，是指县级以上人民政府卫生行政部门及其监督机构依照法定职权和程序，贯彻实施卫生法的活动。县级以上人民政府卫生行政部门，包括县级以上地方人民政府卫生行政部门和国家院卫生行政部门。县级以上地方人民政府行政部门包括：县级人民政府行政部门、设区的市级人民政府卫生行政部门、省级人民政府卫生行政部门。掌握“卫生法的守法、执法和司法”知识点。